某蓄电池厂女工，34岁。以往月经正常，近来月经时常紊乱，经血量过多。何种实验室检查有助于明确诊断
A. 尿酚含量
B. 尿马尿酸含量
C. 尿ZPP含量
D. 尿ALA含量
E. 尿FEP含量

正确答案：D。尿ALA含量

解析：本题考查铅中毒对机体影响。该工人出现月经紊乱的症状是由于接触铅导致的铅中毒。当机体接触铅时，可抑制δ-氨基-γ-酮戊酸脱水酶活性（ALAD）（D对ABCE错）和血红素合成酶活性，表现为尿δ-氨基-γ-酮戊酸含量和血中锌原卟啉水平增加。因此尿δ-氨基-γ-酮戊酸含量可作为反映毒作用的指标。